急性乳腺炎的重要病因是
A. 全身和局部抵抗力下降
B. 乳汁瘀积加细菌入侵
C. 乳腺组织发育不良
D. 哺乳次数增多
E. 乳腺分泌障碍

正确答案：B。乳汁瘀积加细菌入侵

解析：急性乳腺炎的重要病因是乳汁淤积加细菌入侵（B对）。细菌入侵并扩散到乳腺实质是急性乳腺炎的始动因素，乳汁淤积有利于侵入细菌的生长繁殖。全身和局部抵抗力下降（A错）是急性乳腺炎的常见诱因。乳腺组织发育不良（C错）、哺乳次数增多（D错）、乳腺分泌障碍（E错）一般不出现乳汁淤积，不是急性乳腺炎的病因。